女，46岁。持续性心房颤动5年，2年前曾出现言语不利左侧肢体活动障碍。该患者长期抗凝治疗应首选
A. 低分子肝素
B. 潘生丁
C. 华法林
D. 普通肝素
E. 阿司匹林

正确答案：C。华法林

解析：患者中年女性，持续性心房颤动5年，2年前曾出现言语不利左侧肢体活动障碍（提示脑血栓栓塞史），无心脏瓣膜病病史，可得CHADS₂评分=2分，发生血栓栓塞的危险性较高，应该接受华法林抗凝治疗（C对）。口服华法林，使凝血酶原时间国际标准化比值（INR）维持在2.0～3.0，能安全有效预防脑卒中发生。CHADS₂评分=1的患者可考虑华法林或阿司匹林（E错）治疗。普通肝素（D错）和低分子肝素（A错）主要用于房颤的紧急复律治疗。潘生丁（双嘧达莫）（B错）可抑制血小板摄取腺苷，抑制血栓烷素A₂（可促使血小板聚集）的形成达到抗血小板聚集的疗效，一般不用于房颤的抗凝治疗。